执业药师职业道德准则是
A. 为药学事业带来荣誉、发展和提高
B. 共同行为规范与标准，是评价执业行为正确与错误的标准
C. 接受公正、公平、合理的原则
D. 为病人健康服务，确保药品安全、有效、经济、尊重患者人格
E. 符合法律、法规、道德良心的情况下才能进行

正确答案：D。为病人健康服务，确保药品安全、有效、经济、尊重患者人格